关于脊髓灰质炎病毒，哪项错误
A. 主要经粪-口途径传播
B. 为无包膜DNA病毒，分为Ⅰ、Ⅱ、Ⅲ型
C. 各型病毒的中和抗体无交叉保护反应
D. 主要感染脊髓前角运动神经细胞
E. 口服减毒活疫苗可进行预防

正确答案：B。为无包膜DNA病毒，分为Ⅰ、Ⅱ、Ⅲ型